药品监督管理部门在对甲药品经营且监督检查中发现，该企业《药品经营许可证》核定的经营方式为零售（连锁），经营范围为中药饮片、中成药、化学药制剂、抗生素制剂。《药品经营许可证》发证时间为2014年10月8日，检查人员现场检查时还发现，在货架上摆放有生物制品人血白蛋白。对甲企业在《药品经营许可证》有效期届满后，需要继续经营的企业申请换发《药品经营许可证》的期限是
A. 2019年7月8日至2019年10月8日
B. 2019年4月7日至2019年10月7日
C. 2019年10月7日至2020年4月7日
D. 2019年10月8日至2020年1月8日

正确答案：B。2019年4月7日至2019年10月7日

解析：本题考查的是药品经营许可证换发。药品监督管理部门在对甲药品经营且监督检查中发现，该企业《药品经营许可证》核定的经营方式为零售（连锁），经营范围为中药饮片、中成药、化学药制剂、抗生素制剂。《药品经营许可证》发证时间为2014年10月8日，检查人员现场检查时还发现，在货架上摆放有生物制品人血白蛋白。对甲企业在《药品经营许可证》有效期届满后，需要继续经营的企业申请换发《药品经营许可证》的期限是2019年4月7日至2019年10月7日（B对）。药品经营许可证换发：药品经营企业持有的药品经营许可证有效期届满、需要继续经营药品的，应当在有效期届满前6个月，向原发证机关申请换发药品经营许可证。原发证机关按照本办法关于申请办理药品经营许可证的程序和要求进行审查，在药品经营许可证有效期届满前做出是否准予其换证的决定。符合规定准予换证的，收回原证，换发新证；不符合规定的，做出不予换证的书面决定，并说明理由，同时告知申请人享有依法申请行政复议或者提起行政诉讼的权利；逾期未做出决定的，视为同意换证，并予补办相应手续。